男孩，13岁，近1个月自觉体力进行性下降，査体，心前区未触及震颤，胸骨左缘第2-3肋间闻及3/6级收缩期喷射性杂音，P₂增强，固定分裂。最可能的诊断
A. 小型室间隔缺损
B. 房间隔缺损
C. 动脉导管未闭
D. 中间型室间隔缺损
E. 肺动脉瓣狭窄

正确答案：B。房间隔缺损

解析：男孩，13岁，近1个月自觉体力进行性下降（体循环血量不足表现），査体，心前区未触及震颤，胸骨左缘第2-3肋间闻及3/6级收缩期喷射性杂音（房间隔缺损典型杂音），P₂增强，固定分裂（典型听诊特点）。综上所述，患者最可能的诊断房间隔缺损（B对）。小型室间隔缺损（A错）可无症状，一般活动不受限制，生长发育不受影响，仅体格检查时听到胸骨左缘第2肋间响亮的全收缩期杂音，常伴震颤，肺动脉第二心音正常或稍增强。动脉导管未闭（C错）典型杂音为胸骨左缘上方闻及连续性“机器”样杂音，占整个收缩期与舒张期，常伴有震颤，杂音向左锁骨下、颈部和背部传导，当肺血管阻力增高时，杂音的舒张期成分可能减弱或消失。中型室间隔缺损（D错）患儿多生长迟缓，体重不增，有消瘦、喂养困难，活动后乏力、气短、多汗，易患反复呼吸道感染，易导致充血性心力衰竭等。肺动脉瓣狭窄（E错）一般心前区可较饱满、搏动弥散，左侧胸骨旁可触及右心室抬举搏动，胸骨左缘第2、3肋间可闻及Ⅳ/Ⅳ级以上喷射性收缩期杂音，向左上胸、心前区、颈部、腋下及背面传导。